以下哪种疾病增大可致鼻唇沟消失，鼻翼抬高，鼻孔变形
A. 鼻腭管囊肿
B. 甲状舌管囊肿
C. 鳃裂囊肿
D. 切牙管囊肿
E. 鼻唇（鼻牙槽）囊肿

正确答案：E。鼻唇（鼻牙槽）囊肿

解析：鼻唇（鼻牙槽）囊肿增大可致鼻唇沟消失，鼻翼抬高，鼻孔变形。掌握“鼻腭管囊肿及鼻唇囊肿”知识点。